男性，52岁。渐起右上下肢抖动1年半，既往史无特殊。检查：血压150/95mmHg，神志清楚，表情呆板，右上下肢肌力正常，肌张力增高，呈齿轮样，在上下肢可见静止性震颤，余神经系统检查未发现异常。该患者治疗过程中不能应用的药
A. 苯海索
B. 甲基多巴
C. 金刚烷胺
D. 美多巴
E. 苯海拉明

正确答案：B。甲基多巴